男，20岁。1型糖尿病病史10年，平时每日4次胰岛素强化治疗。近2日发热，咽痛,食欲不振，进食少，自行停用胰岛素。晨起家属发现患者不能正确回答问题，急诊就诊，查体:T38.5°C,精神差，轻度脱水貌。实验室检查:血钠140mmol/L，血钾4.5mmol/L，血糖25mmol/L，血pH7.25，尿酮体（+++）。最适合的治疗方案
A. 恢复四次胰岛素皮下注射治疗
B. 静脉大剂量短效胰岛素治疗
C. 皮下胰岛素泵治疗
D. 静脉小剂量短效胰岛素治疗
E. 基础胰岛素皮下治疗

正确答案：D。静脉小剂量短效胰岛素治疗

解析：1型糖尿病患者（酮症酸中毒好发人群），自行停用胰岛素（诱因）后出现意识障碍、轻度脱水，血糖25mmol/L（血糖正常值3.9～6.0mmol/L），尿酮体（+++），血pH 7.25（pH正常值7.35～7.45，＜7.35提示酸中毒），可诊断为糖尿病酮症酸中毒。糖尿病酮症酸中毒需给予足量胰岛素治疗，一般采用静脉注射小剂量（短效）胰岛素治疗方案（D对），即每小时给予每公斤体重0.1U胰岛素，使血清胰岛素浓度恒定到100～200μU/ml，这已有抑制脂肪分解和酮体生成的最大效应以及相当强的降低血糖效应，而促进钾离子转运的作用较弱，因此患者无需大剂量胰岛素治疗（B错）。病情稳定后方可使用皮下注射胰岛素治疗（ACE错）。